寒痰的特征是
A. 黄而粘稠，坚而成块
B. 白而清稀
C. 清稀而多泡沫
D. 白滑而量多，易咯
E. 少而粘，难咯

正确答案：B。白而清稀

解析：因寒邪阻肺，津凝不化，聚而为痰，或脾阳不足，湿聚为痰，上犯于肺所致，故白而清稀为寒痰（B对）。痰黄而粘稠，坚而成块者为热痰，因热邪犯肺，煎津为痰，痰聚于肺所致（A错）。痰清稀而多泡沫者为风痰，多因肝风挟痰，上扰清窍所致（C错）。痰白滑而量多，易咯者多属湿痰。因脾失健运，水湿内停，湿聚为痰，上犯于肺所致（D错）。少而粘，难咯者属燥痰。因燥邪犯肺，耗伤肺津所致（E错）。